患者胃肠热盛，大便秘结。腹满硬痛而拒按，潮热，神昏谵语，但又兼见面色苍白，四肢厥冷，精神萎顿。其病机是
A. 虚中夹实
B. 真实假虚
C. 由实转虚
D. 真虚假实
E. 实中夹虚

正确答案：B。真实假虚

解析：患者热结胃肠的里热炽盛证，一方面有大便秘结、腹痛硬满、谵语等实热症状，同时因阳气被郁，不能四布，而见面色苍白、四肢逆冷、精神萎顿等状似虚寒的假象符合真实假虚的临床表现，所以可以排除其它的错误选项（B对）。